含有格列本脲的中成药是
A. 消渴丸
B. 脉君安片
C. 益康胶囊
D. 脉络通颗粒
E. 维血康糖浆

正确答案：A。消渴丸

解析：本题考查的是含西药组分的中成药。含有格列本脲的中成药是消渴丸（A对）。消渴丸：功能滋肾养阴，益气生精。用于气血两虚型消渴病。症见多饮、多尿、多食、消瘦、体倦乏力、眠差、腰痛型糖尿病见上述证候者。含西药成分格列本脲。脉君安片（B错）：功能平肝息风，解肌止痛。用于高血压、头痛眩晕、颈项强痛、失眠心悸、冠心病等。含西药成分氢氯噻嗪。益康胶囊（C错）：功能调节全身代谢，恢复细胞活力，改善心血管功能，健脑健身，延缓衰老，扶正固本。用于冠心病、高脂血症、脑动脉硬化、老年性视力减退。对甲状腺功能减退症和慢性老年性支气管炎患者有辅助治疗作用。含西药成分维生素E、维生素A。脉络通颗粒（D错）：功能益气活血，化瘀止痛。用于气虚血瘀所致的胸痹，症见心胸疼痛、胸闷气短、头痛眩晕；冠心病心绞痛见上述证候及中风所致的肢体麻木、半身不遂。含西药成分维生素C、碳酸氢钠。维血康糖浆（E错）：功能补肾健脾，补血养阴。用于腰膝酸软、倦怠体瘦；以及营养性贫血、缺铁性贫血属上述证候者。含西药成分硫酸亚铁。